结核病最重要的社会传染源是
A. 原发性肺结核
B. 浸润型肺结核
C. 急性粟粒性肺结核
D. 慢性血行播散型肺结核
E. 慢性纤维空洞型肺结核

正确答案：E。慢性纤维空洞型肺结核

解析：继发性肺结核好发于两肺上叶尖后段或下叶尖段，肺门淋巴结很少肿大，病灶趋于局限，但易有干酪坏死和空洞形成（即指慢性纤维空洞型肺结核），排菌较多，不同于大多数原发性肺结核不治而愈、很少排菌的特点，在流行病学上更具有重要性。根据八版病理学（P353）浸润性肺结核是临床上最常见的活动性、继发性肺结核，强调活动性，当急性空洞经久不愈，病变进一步发展为慢性纤维空洞型肺结核，病变空洞与支气管相通，使其中的结核杆菌更易排出（E对）。